下列哪一种说法是错误的？
A. 机体对大多数应激原的感受都包含有认知因素
B. 昏迷病人对应激原都会出现应激反应
C. 蓝斑投射区NE水平升高，机体出现紧张专注程度也升高
D. HPA轴的适度兴奋有助于维持良好的认知学习能力和良好情绪
E. HPA轴兴奋过度或不足都可以CNS的功能障碍出现抑郁厌食，甚至自杀倾向

正确答案：B。昏迷病人对应激原都会出现应激反应

解析：机体对大多数应激原的感受都包含有认知因素（A对），但昏迷病人由于意识丧失，机体不会对应激原出现应激反应（B错，为本题正确答案）;蓝斑投射区NE水平升高，机体出现紧张专注程度也升高（C对）;HPA轴的适度兴奋有助于维持良好的认知学习能力和良好情绪（D对），但HPA轴兴奋过度或不足都可以CNS的功能障碍出现抑郁厌食，甚至自杀倾向（E对）。